治疗热结型便秘，除取主穴外，还应加
A. 脾俞、胃俞
B. 气海、神阙
C. 关元、命门
D. 合谷、曲池
E. 中脘、行间

正确答案：D。合谷、曲池

解析：本题考查便秘的随症配穴。脾俞善于治疗脾胃疾患如腹胀、腹泻、痢疾、呕吐、纳呆、水肿等，胃俞善于治疗胃疾，多食善饥，身体消瘦，两者功效中没有提及热结型便秘（A错）。气海主治虚脱，厥逆，腹痛，泄泻等病症，神阙主治病症为泄痢，绕脐腹痛，脱肛，五淋等，两者功效中没有提及热结型便秘（B错）。关元主治中风脱症，肾虚气喘，遗精等，命门主治虚损腰痛，脊强反折，遗尿，尿频，泄泻，遗精，白浊，阳萎，早泄，赤白带下，胎屡坠，五劳七伤，头晕耳鸣，癫痫，惊恐，手足逆冷等，两者功效中没有提及热结型便秘（C错）。针灸治疗便秘的主穴是:天枢、支沟、水道、归来、丰隆。热秘者，加合谷、曲池清泻阳明之热邪，合谷、曲池均为手阳明大肠经的穴（D对）。中脘主治胃痛，呕吐，呃逆，反胃等，行间主治主治头痛眩晕，青盲，雀目等，两者功效中没有提及热结型便秘（E错）。